不属于一次环境污染物的是
A. SO₂
B. 可吸入颗粒物
C. 甲基汞
D. NOₓ
E. CO₂

正确答案：C。甲基汞

解析：本题考查一次污染物。一次污染物是指由污染源直接排入大气环境中，其物理和化学性质均未发生变化的污染物。如汞、SO₂（A对）、可吸入颗粒物（B对）、NOₓ（D对）、CO、CO₂（E对）等。甲基汞（C错，为本题正确答案）属于二次污染物。